男，36岁，5天前发热咽疼，应用抗生素治疗无效。颈部浅表淋巴结肿大，咽部充血，扁桃体Ⅱ°肿大，下肢少许瘀斑。白细胞16.6×10⁹/L，原始细胞0.60，血红蛋白80g/L，血小板34×10⁹/L。最可能的诊断是
A. 特发性血小板减少性紫癜
B. 缺铁性贫血
C. 再生障碍性贫血
D. 溶血性贫血
E. 急性白血病

正确答案：E。急性白血病

解析：患者青年男性，发热、咽疼5天，咽部充血，扁桃体Ⅱ°肿大，应用抗生素治疗无效（白血病患者正常骨髓造血受抑，易继发感染，以口腔炎、牙龈炎、咽峡炎最常见）。查体：颈部浅表淋巴结肿大（白血病细胞增殖浸润可导致淋巴结、肝脾肿大），下肢少许瘀斑（出血表现）。血常规：血红蛋白80g／L（成年男性Hb正常值120～160g／L），提示贫血，血小板34×10⁹/L（100～300×10⁹/L）（白血病患者血小板常减少），白细胞16.6×10⁹／L（正常4～10×10⁹／L）增多，原始细胞0.60（正常人外周血不会出现原始细胞），提示白血病，故患者最可能的诊断是急性白血病（E对）。特发性血小板减少性紫癜（P614）（A错）可有贫血、皮肤黏膜出血，血小板计数减少，但外周血中不会出现原始细胞；缺铁性贫血（P542）（B错）主要表现为贫血，白细胞、血小板常正常或减低，血小板也可增高，外周血中不会出现白血病细胞；再生障碍性贫血（P547-P548）（C错）主要表现为全血细胞减少，贫血、感染、出血等症状，但无肝、脾、淋巴结肿大；溶血性贫血（P552）（D错）主要表现为血红蛋白尿、贫血、黄疸、脾大等症状，白细胞、血小板常正常。